健康人血白蛋白（白蛋白）主要用于
A. 补充营养
B. 增强机体抵抗力
C. 低血容量性休克的扩容治疗
D. 自身免疫性疾病的治疗
E. 低丙种球蛋白血症的替代疗法

正确答案：C。低血容量性休克的扩容治疗

解析：健康人血白蛋白，简称白蛋白，从混合人血浆中提取而得，常用于低血容量性休克的扩容治疗（C对）、脑水肿的脱水、各种原因引起的低蛋白血症。补充营养（A错）一般应用富含蛋白质的食物或营养剂，而非白蛋白。增强机体抵抗力（B错）、自身免疫性疾病的治疗（D错）、低丙种球蛋白血症的替代疗法（E错）均是免疫球蛋白的适应症。